适用于湿颗粒流化干燥的方法是
A. 喷雾干燥
B. 冷冻干燥
C. 减压干燥
D. 烘房干燥
E. 沸腾干燥

正确答案：E。沸腾干燥

解析：本题考查干燥方法。适用于湿颗粒流化干燥的方法是沸腾干燥（E对）。沸腾干燥，又称流床干燥，系指利用热空气流使湿颗粒悬浮，呈流态化，似“沸腾状”，热空气在湿颗粒间通过，在动态下进行热交换，带走水汽而达到干燥的一种方法。喷雾干燥（A错）法是流态化技术用于浸出液干燥的一种较好方法，系直接将浸出液喷雾于干燥器内使之在与通人干燥器的热空气接触过程中，水分迅速汽化，从而获得粉末或颗粒的方法。冷冻干燥（B错）法系将浸出液浓缩至一定浓度后预先冻结成固体，在低温减压条件下将水分直接升华除去的干燥方法。减压干燥（C错），又称真空干燥，系指在负压条件下而进行干燥的一种方法。烘干法系指将湿物料摊放在烘盘内，利用热的干燥气流使湿物料水分汽化进行干燥的一种方法。由于物料处于静止状态，所以干燥速度较慢。常用的有烘箱和烘房。烘房（D错）：为供大量生产用的烘箱，其结构原理与烘箱一致，但由于容量大，在设计上更应注意温度、气流路线及流速等因素间的相互影响，以保证干燥效率。